延髓内的内侧丘系交叉位于
A. 锥体交叉下方
B. 锥体交叉
C. 锥体交叉上方
D. 橄榄
E. 橄榄上方

正确答案：C。锥体交叉上方

解析：延髓内的内侧丘系交叉位于锥体交叉上方（C对）。